患者，女，26岁。阴部瘙痒2天，坐卧不安，带下量多，色黄质稠，其气臭秽，心烦少寐，口苦而黏腻，舌苔黄腻，脉弦数，其证候是
A. 湿浊下注
B. 寒湿下注
C. 湿热下注
D. 痰湿内盛
E. 脾虚夹湿

正确答案：C。湿热下注

解析：患者带下量多，阴部瘙痒，色黄质稠，其气臭秽，是因为湿热蕴结于下，损伤任带二脉；肝经湿热内盛，阻于中焦，故心烦少寐，口苦而腻；舌苔黄腻，脉弦数为湿热之证（C对）。女子带下状如凝乳或豆腐渣，多因湿浊下注所致（A错）。带下色白最多，质稀如涕，淋漓不绝而无臭味的症状，多因脾肾阳虚，寒湿下注所致（B错）。痰湿证是以咳嗽痰多、胸闷、呕恶、眩晕、体胖等为主要表现的证候（D错）。脾虚夹湿证是以纳呆、腹胀、便溏、身重与寒湿症状为主要表现的证候（E错）。